不属于免疫细胞检测技术的是
A. 流式细胞术
B. 免疫印迹
C. 增殖试验
D. 细胞毒试验
E. 细胞凋亡检测

正确答案：B。免疫印迹